依据《中华人民共和国药品管理法实施条例》，以下关于医疗机构配制的制剂的表述正确的是
A. 不得在市场上销售或者变相销售
B. 不得发布广告
C. 不得在医疗机构之间调剂使用
D. 不得办理变更配制场所的手续
E. 不得配制未取得制剂批准文号的制剂

正确答案：A、B、E。不得在市场上销售或者变相销售；不得发布广告；不得配制未取得制剂批准文号的制剂

解析：本题考查医疗机构的制剂管理。《中华人民共和国药品管理法实施条例》第二十三条：医疗机构配制制剂，必须按照国务院药品监督管理部门的规定报送有关资料和样品，经所在地省、自治区、直辖市人民政府药品监督管理部门批准，并发给制剂批准文号后，方可配制（E对）。《中华人民共和国药品管理法实施条例》第二十四条：医疗机构配制的制剂不得在市场上销售或者变相销售（A对），不得发布医疗机构制剂广告（B对）。发生灾情、疫情、突发事件或者临床急需而市场没有供应时，经国务院或者省、自治区、直辖市人民政府的药品监督管理部门批准，在规定期限内，医疗机构配制的制剂可以在指定的医疗机构之间调剂使用（C错）。《中华人民共和国药品管理法实施条例》第二十一条：医疗机构变更《医疗机构制剂许可证》许可事项的，应当在许可事项发生变更30日前，依照本条例第二十条的规定向原审核、批准机关申请《医疗机构制剂许可证》变更登记（D错）；未经批准，不得变更许可事项。原审核、批准机关应当在各自收到申请之日起15个工作日内作出决定。